β受体阻滞剂，可用于治疗心律失常的药物是
A. 盐酸普萘洛尔
B. 氯贝丁酯
C. 硝苯地平
D. 甲基多巴
E. 卡托普利

正确答案：A。盐酸普萘洛尔

解析：本题考查β受体阻滞剂。β受体阻滞剂，可用于治疗心律失常的药物是盐酸普萘洛尔（A对）。盐酸普萘洛尔为β受体阻断药，主要用于治疗室上性心律失常。对交感神经兴奋性增高、甲状腺功能亢进及嗜铬细胞瘤等引起的窦性心动过速效果好。氯贝丁酯（B错）为调血脂药。硝苯地平（C错）是第一代二氢吡啶类的短效钙通道阻滞药，对冠脉的痉挛作用显著，故对变异型心绞痛最有效，伴高血压或窦性心动过缓的患者尤为适用；亦可用于慢性稳定型心绞痛和不稳定型心绞痛的防治。甲基多巴（D错）属于中枢性降压药。卡托普利（E错）血管紧张素转换酶抑制剂，适用于各型高血压。对伴有左心室肥厚、左心功能障碍、急性心肌梗死、糖尿病肾病的高血压患者，ACEI是首选药。